齿燥如枯骨者，属
A. 热盛伤津
B. 阳明热盛
C. 肾阴枯涸
D. 胃阴不足
E. 肾气虚乏

正确答案：C。肾阴枯涸

解析：齿燥如枯骨，多因肾阴枯涸、精气内竭所致（C对）。牙齿黄而干燥者，多因热盛伤津所致，且见于温病极期（A错）。牙齿光燥如石，多因阳明热盛所致（B错）。龈肉萎缩而色淡者，多属胃阴不足，或肾气虚乏（DE错）。